正常人每日唾液总量为1000～1500ml，其中腮腺和下颌下腺的分泌量占
A. 0.5
B. 0.6
C. 0.7
D. 0.8
E. 0.9

正确答案：E。0.9

解析：本题考查唾液分泌。正常人每日唾液总量为1000～1500ml，其中腮腺和下颌下腺的分泌量占90%（E对）。正常成人每天的唾液分泌量为1000～1500mL，其中的绝大多数来自三对大唾液腺。在无任何刺激的情况下，唾液的基础分泌为每分钟0.5mL。下颌下腺静止时分泌量最大，占60%～65%；腮腺占22%～30%，但对于进食等刺激的反应大于下颌下腺；舌下腺约占2%～4%；小唾液腺约占7%～8%。